以下哪项属于固定桥中的冠内固位体形式
A. 全冠
B. 桩冠
C. 嵌体
D. 开面冠
E. 甲冠

正确答案：C。嵌体

解析：本题考查固定桥的设计。冠内固位体即嵌体（C对）固位体，因其固位力差，外形线长，容易产生继发龋，较少使用。